合成VLDL的主要场所是
A. 脂肪组织
B. 肾
C. 肝
D. 小肠黏膜
E. 血浆

正确答案：C。肝